切牙中体积最大，近远中径最宽的牙齿是
A. 上颌中切牙
B. 下颌侧切牙
C. 上颌乳中切牙
D. 下颌乳侧切牙
E. 上颌尖牙

正确答案：A。上颌中切牙

解析：本题考查牙体解剖外形。切牙中体积最大，近远中径最宽的牙齿是上颌中切牙（A对）。下颌侧切牙（B错）体积较下颌中切牙大。上颌乳中切牙与上颌恒中切牙形态相似，但体积较小（C错）。下颌乳侧切牙与下颌恒侧切牙外形相似，但不如它窄长（D错）。上颌尖牙（E错）是全口牙中牙体和牙根最长的牙。